“孤阴不生，独阳不长”是阴阳之间哪种关系破坏所导致
A. 对立制约
B. 互根互用
C. 消长平衡
D. 相互转化
E. 相互统一

正确答案：B。互根互用

解析：阴阳互根互用，由于某些原因，阴与阳之间的互根关系遭到破坏，就会导致“独阴不生，独阳不生”（B对）。阴阳之间的对立制约（A错）关系失调，动态平衡遭到了破坏，则标志着疾病的产生，阴阳双方中的一方过于亢盛，则过度制约另一方而致其不足，阴胜则阳病，阳胜则阴病体现的就是阴阳对立制约关系的失调。阴阳的消长变化（C错）超越了正常的限度，在自然界表征异常的气候变化，在人体则表征疾病的发生。“精气两虚”、“气血两虚”，属于阴阳互根互用关系失常而出现的异常的阴阳皆消。